农药粉尘属于
A. 矿物性粉尘
B. 人工合成的无机粉尘
C. 人工合成的有机粉尘
D. 混合性粉尘
E. 有机粉尘

正确答案：C。人工合成的有机粉尘